男，7岁。右下后牙疼痛1周，脸肿3天。检查：大面积龋坏，叩痛（+++），龈颊沟变浅，扪及波动感，扪痛（+++），近中牙合面深龋洞，叩诊（-），温度测试同对照牙。X线显示：Ⅳ根分歧大面积低密度影，远中根吸收2/3，恒牙胚囊不连续，上方骨板模糊不清。龋近髓，骨硬板连续。初诊治疗方法是
A. 拔除引液
B. 开髓开放，口服消炎药
C. 根管开放，口服消炎药
D. 根管开放，脓肿切开
E. 脓肿切开

正确答案：A。拔除引液

解析：本题考查乳牙拔除的适应证。根尖周炎的乳牙，根尖及根分叉区骨质破坏范围广，尤其是骨质破坏、炎症已涉及继承恒牙牙胚时应予以拔除。本病例中患牙大面积龋坏，叩痛（+++），龈颊沟变浅，扪及波动感，扪痛（+++），近中牙合面深龋洞，Ⅳ根分歧大面积低密度影，远中根吸收2/3，恒牙胚囊不连续，上方骨板模糊不清，可以诊断为慢性根尖周炎的急性发作，患牙根分歧区骨质破坏严重累及继承恒牙牙胚，骨膜下脓肿明显，故应予以拔除引液（A对），以防止炎症扩散导致间隙感染。开髓开放，口服消炎药（B错）、根管开放，口服消炎药（C错）、根管开放，脓肿切开（D错）和脓肿切开（E错）都是保存患牙，控制炎症的治疗方法，该病例中患牙已无保留价值，没必要进行这些处理。